哪项正确
A. 上口狭小,向前下倾斜
B. 下口宽大,向前下倾斜
C. 上8个肋连于胸骨
D. 运动时只有前后径变化
E. 肋下降时,助吸气

正确答案：A。上口狭小,向前下倾斜

解析：胸廓上口较小，由于胸廓上口的平面与第 1 肋的方向一致，向前下倾斜（A对）。胸廓下口宽而不整（B错）。第 1 -7 对肋前端直接与胸骨连结，称真肋（C错）。吸气时，在肌作用下，肋的前部抬高，从而加大了胸廓的前后径，肋上提时，肋体向外扩展，加大胸廓横径（D错），使胸腔容积增大，呼气时，在重力和肌肉作用下，胸廓作相反的运动（E错）。